男，20岁。因发热伴明显头痛呕吐2天，神志恍惚半天，于1月5日来诊。1个月前由外地前来打工，生活条件差。查体：T39.5℃，P120次/分，BP130/80mmHg，神志恍惚烦躁，皮肤散在皮疹，压之不褪色，颈抵抗，Kerning征（+）。实验室检查：血WBC21×10⁹/L，NO.89，CSF检查：压力200mmH₂O，有核细胞25000×10⁶/L，多核0.95，蛋白升高，糖氯化物降低，首先考虑的诊断是
A. 结核性脑膜炎
B. 隐球菌性脑膜炎
C. 流行性脑脊髓膜炎
D. 病毒性脑膜炎
E. 乙型脑炎

正确答案：C。流行性脑脊髓膜炎

解析：从患者的辅助检查来看，白细胞数极高，中性粒比例增高，考虑细菌性感染。脑脊液压力较高，且白细胞数较多，蛋白升高，糖、氯化物降低，符合化脓性脑膜炎脑脊液表现，故考虑为化脓性脑膜炎。患者于冬季发病，冬季为流行性脑脊髓膜炎的发病高峰期，且患者出现脑膜炎双球菌败血症的典型皮疹表现，故该患者符合流行性脑脊髓膜炎（C对）的诊断。结核性脑膜炎（A错）患者可有明显结核中毒表现，查体可见脑膜刺激征，其脑脊液检查可见外观清亮，细胞数明显增高，以淋巴细胞为主，蛋白质增高，抗酸染色阳性。隐球菌性脑膜炎（B错）起病隐匿，进展缓慢，脑脊液检查压力增高，淋巴细胞轻、中度增多，蛋白质含量增高，糖含量降低，墨汁染色可检出隐球菌。病毒性脑膜炎（D错）以夏秋季为高发季节，脑脊液检查外观清亮，压力正常或轻度增高，白细胞轻度增多，蛋白质可轻度增高，糖和氯化物含量正常。乙型脑炎（E错）经蚊虫传播，夏秋季高发，表现为高热、惊厥、意识障碍等，脑脊液检查可见无色透明，压力仅轻度增高，白细胞计数增加，糖和蛋白质轻度增高，氯化物正常。